理发店对一些头癣等皮肤传染病顾客采用下列哪个方法是正确的
A. 拒绝服务
B. 让顾客自带理发用具，方可服务
C. 用公用理发工具给顾客服务
D. 用理发店专门提供的皮肤传染病顾客理发工具服务
E. 建议去其他理发店

正确答案：D。用理发店专门提供的皮肤传染病顾客理发工具服务

解析：本题考查《理发店、美容店卫生标准》。理发店对一些头癣等皮肤传染病顾客应采用专门提供的理发用具（D对ABCE错），用后应及时消毒。